关于热原的说法，错误的是
A. 热原具有水溶性和挥发性，能通过一般滤器
B. 热原能被强酸或强碱破坏
C. 临床使用注射器具可能被热原污染
D. 产生热原反应的最主要致热物质是内毒素
E. 采用吸附法可除去注射液中的热原

正确答案：A。热原具有水溶性和挥发性，能通过一般滤器

解析：本题考查的是热原的基本性质。热原具有水溶性和不挥发性，能通过一般滤器（A错，为本题正确答案）。热原的基本性质：（1）耐热性：通常灭菌条件下，热原往往不能被破坏。采用180℃加热3～4小时，250℃加热30～45分钟或650℃加热1分钟可使热原彻底破坏。（2）水溶性：热原能溶于水，其浓缩水溶液往往带有乳光。（3）不挥发性：热原本身不挥发，但因溶于水，在蒸馏时可随水蒸气雾滴进入蒸馏水中，因此蒸馏水器应有完好的隔膜装置，以防热原污染。（4）滤过性：热原体积小，约在1～5nm之间，一般滤器均不能将热原除去，即使微孔滤膜也不能将其截留，然而孔径小于1nm的超滤膜可除去绝大部分甚至全部热原。（5）被吸附性：热原可以被活性炭、纸浆滤饼等吸附（E对）。热原在水溶液中带有电荷，也可被某些离子交换树脂吸附。（6）其他性质：热原能被强酸、强碱破坏（B对），也能被强氧化剂如高锰酸钾或过氧化氢等破坏，超声波及某些表面活性剂也能使之失活。临床使用注射器具可能被热原污染（C对）。产生热原反应的最主要致热物质是内毒素（D对）。